口腔医疗保健中，主要经接触传播的微生物是
A. 丙肝病毒
B. 水痘病毒
C. 麻疹病毒
D. 风疹病毒
E. 流行性腮腺炎病毒

正确答案：A。丙肝病毒

解析：本题考查口腔医疗保健中的感染。口腔医疗保健中，主要经接触传播的微生物是丙肝病毒（A对）。经接触传播的微生物包括：乙肝病毒、丙肝病毒、丁肝病毒、单纯疱疹病毒Ⅰ型、单纯疱疹病毒Ⅱ型、人类免疫缺陷病毒、淋病双球菌、梅毒螺旋体、铜绿假单胞菌、金色/白色葡萄球菌、破伤风杆菌。经空气传播的主要微生物包括：水痘病毒（B错）、麻疹病毒（C错）、风疹病毒（D错）、流行性腮腺炎病毒（E错）、流感病毒、结核杆菌、化脓性链球菌。